某女，50岁。患咳喘20年，刻下咳喘气逆痰多，兼见带下、尿频，宣选用的药是
A. 白前
B. 白果
C. 芡实
D. 马兜铃
E. 洋金花

正确答案：B。白果

解析：本题考查的是白果的主治病证。患咳喘20年，刻下咳喘气逆痰多，兼见带下、尿频，宣选用的药是白果（B对）。白果：【主治病证】（1）咳喘气逆痰多。（2）白浊，带下，尿频、遗尿。白前（A错）：【主治病证】肺气壅实之咳喘气逆、痰多。芡实（C错）：【主治病证】（1）脾虚久泻不止。（2）肾虚遗精，小便不禁，白带过多。马兜铃（D错）：【主治病证】（1）肺热咳嗽。（2）肺虚有热之咳喘或痰中带血。（3）痔疮肿痛、出血。洋金花（E错）：【主治病证】（1）咳嗽哮喘。（2）小儿慢惊。（3）脘腹冷痛，风湿痹痛，外科麻醉。